下列尘肺中，弥漫性肺间质纤维化是其基本病理改变的是
A. 棉尘症
B. 农民肺
C. 石棉肺
D. 结节型硅沉着病
E. 煤工尘肺

正确答案：C。石棉肺